关于心底的说法，错误的是
A. 朝向右后上方
B. 由左心室和右心室构成
C. 连接出入心脏的大血管
D. 是心脏比较固定的部分
E. 是由左、右心房组成

正确答案：B。由左心室和右心室构成

解析：心底朝向右后上方（A对）。主要由左心房和小部分的右心房构成（E对B错，为本题正确答案）。连接出入心脏的大血管（C对）。是心脏比较固定的部分（D对）。